关于颞下颌关节强直造成的咬合错乱，不正确的是
A. 面下1/3垂直距离变短
B. 下颌牙弓变宽
C. 下颌磨牙舌向倾斜
D. 下颌切牙唇侧倾斜
E. 发生于成年者，咬合错乱不明显

正确答案：B。下颌牙弓变宽

解析：本题考查颞下颌关节强直造成的（牙合）关系错乱。关于颞下颌关节强直造成的咬合错乱，不正确的是下颌牙弓变宽（B错，为本题的正确答案）。颞下颌关节强直造成的（牙合）关系错乱：下颌骨发育障碍造成面下部垂直距离变短（A对），牙弓变小而狭窄；牙的排列和垂直方向生长均受阻碍，结果造成（牙合）关系错乱；下颌磨牙常倾向舌侧（C对），下颌牙的颊尖咬于上颌牙的舌尖；下颌切牙向唇侧倾斜呈扇形分离（D对）；如果关节强直发病于成年人或青春发育期后，因下颌骨发育几近完成，则面部和（牙合）关系无明显畸形（E对），仅有开口受限。